患者妊娠2个月，食少便软，面色萎白，语声低微，四肢乏力，舌质淡，脉细缓。治疗应首选
A. 四物汤
B. 归脾汤
C. 当归补血汤
D. 四君子汤
E. 八珍汤

正确答案：D。四君子汤

解析：患者妊娠2个月，食少便软，面色萎白，语声低微，四肢乏力，舌质淡，脉细缓。由脾胃气虚，运化乏力所致。方用四君子汤。人参益气、健脾养胃；白术健脾燥湿，加强益气助运之力；茯苓健脾渗湿；甘草益气和中，调和诸药（D对）。四物汤是补血调经的主方（A错）。归脾汤方证因思虑过度，劳伤心脾，气血亏虚所致。为治疗心脾气血两虚的常用方（B错）。当归补血汤证为劳倦内伤，血虚气弱，阳气浮越所致。为补气生血的基础方（C错）。八珍汤所治气血两虚证多由久病失治、或病后失调、或失血过多而致（E错）。